患者两胁胀痛，痛无定处，食少纳呆，舌苔薄白，脉弱。实验室检查：血清转氨酶258u/L，HBsAg阳性。其证型是
A. 肝肾阴虚
B. 肝胆湿热
C. 瘀血阻络
D. 肝郁脾虚
E. 脾肾阳虚

正确答案：D。肝郁脾虚

解析：患者两胁胀痛，痛无定处，血清转氨酶升高，HBsAg阳性，为肝硬化，肝气失于调达，阻于胁络，故胁肋胀痛，气属无形，时聚时散，故痛无定处，肝气横逆，易犯脾胃，故食少纳呆，故为肝郁脾虚证，治法是疏肝理气，健脾利湿。方药选用柴胡疏肝散合胃苓汤加减。（D对）。肝肾阴虚（A错）表现为腹大胀满，甚或青筋暴露，口干舌燥，心烦失眠，牙龈出血，时或鼻衄，小便短少。肝胆湿热（B错）的特点为腹大坚满，脘腹撑急，烦热口苦，渴不欲饮，或面目肌肤发黄。瘀血阻络（C错）的特点为脉络怒张，胁腹刺痛，面色晦暗黧黑，面颈胸臂可见红点赤缕。脾肾阳虚（E错）表现为腹大胀满，形如蛙腹，朝宽暮急，神疲怯寒，下肢浮肿，小便短少不利。